以下关于根管治疗术叙述不正确的是
A. 术前拍摄X线片了解根尖周病变和牙根吸收情况
B. 在局麻下或牙髓失活后，将全部牙髓摘除
C. 适用于牙髓炎症涉及根髓，不宜行牙髓切断术的患牙
D. 去除髓室和根管内坏死牙髓组织,适当扩锉根管
E. 充分冲洗、消毒根管，采用5％过氧化氢溶液

正确答案：E。充分冲洗、消毒根管，采用5％过氧化氢溶液

解析：本题考查根管治疗术。以下关于根管治疗术叙述不正确的是充分冲洗、消毒根管，采用5％过氧化氢溶液（E错，为本题正确答案）。1.适用：牙髓炎症涉及根髓，不宜行牙髓切断术的患牙（C对）。牙髓坏死及根尖周炎而具保留价值的乳牙。2.治疗步骤：①术前拍摄X线片：了解根尖周病变和牙根吸收情况（A对）。②在局麻下或牙髓失活后，将全部牙髓摘除（B对）。失活剂可用多聚甲醛或金属砷。③制备洞形：去除龋坏组织制备洞形，开髓，揭去髓室顶。④根管预备：去除髓室和根管内坏死牙髓组织，适当扩锉根管（D对）。充分冲洗、消毒根管。采用3%过氧化氢溶液，0.5%～5.25%次氯酸钠溶液，生理盐水溶液冲洗根管，吸干。⑤根管消毒：根管内封入氢氧化钙制剂或髓室内放置蘸有甲醛甲酚、樟脑酚或木榴油的不饱和小棉球，氧化锌丁香油糊剂暂封窝洞。⑥根管充填：3～7天后如果无症状，去除原暂封物，冲洗吸干隔湿，将根管充填材料导入或注入根管，垫底常规充填。如果炎症未能控制也可更换药物，待炎症缓解后再进行根管充填。